男性，40岁，反复上腹疼痛5年余，平卧时加重，弯腰可减轻，查体：上腹部轻压痛，X线腹部摄片左上腹部钙化，可能的诊断是
A. 慢性胃炎
B. 慢性胆囊炎
C. 慢性胰腺炎
D. 慢性十二指肠球炎
E. 慢性肝炎

正确答案：C。慢性胰腺炎

解析：中年男性患者，有反复发作上腹痛病史、平卧加重、弯腰减轻（慢性胰腺炎的典型症状）。X线腹部摄片左上腹钙化（慢性胰腺炎典型的影像学表现）。综合患者的病史、临床表现、影像学检查，可能的诊断是慢性胰腺炎（C对）。慢性胆囊炎（B错）主要表现为进食油腻食物后右上腹阵发性绞痛，常放射至右肩背部。慢性十二指肠球炎（D错）多表现为中上腹的疼痛，伴有反酸、嗳气等，X线腹部摄片常表现为激惹现象。慢性胃炎（A错）、慢性肝炎（E错）一般表现为上腹痛、消化不良等症状，但X线腹部摄片一般无钙化。